疾病分布呈散发形式的原因
A. 该病常年流行
B. 隐性感染为主的传染病
C. 传播机制难以实现的传染病
D. 潜伏期长的传染病
E. 以上均包括

正确答案：E。以上均包括